单纯型过敏性紫癜的消退周期为
A. 1～2日
B. 4～5日
C. 5～7日
D. 7～14日
E. 28日

正确答案：D。7～14日

解析：本题考查过敏性紫癜。单纯型紫癜发生后，经过7～14日（D对）消退，然后不断有新的紫癜出现。